有关片剂包衣错误的叙述是
A. 可以控制药物在胃肠道的释放速度
B. 滚转包衣法适用于包薄膜衣
C. 包隔离层是为了形成一道不透水的障碍，防止水分浸入片芯
D. 用聚乙烯吡咯烷酮包肠溶衣，具有包衣容易、抗胃酸性强的特点
E. 乙基纤维素为水分散体薄膜衣材料

正确答案：D。用聚乙烯吡咯烷酮包肠溶衣，具有包衣容易、抗胃酸性强的特点

解析：本题考查片剂的包衣。聚乙烯吡咯烷酮（PVP）在水或胃液中可以溶解，故不具有抗胃酸性（D错，为本题正确答案）；包衣可以控制药物在胃肠道的释放速度（A对）；包薄膜衣可以用滚转包衣法（B对）；隔离层是在片芯外起隔离作用的衣层，以防止水分透入片芯（C对）；乙基纤维素（EC）为水分散体薄膜衣材料（E对）。